根折常发生于
A. 成熟恒牙根尖1/3
B. 年轻恒牙根中1/3
C. 成熟恒牙根中1/3
D. 根颈侧1/3
E. 年轻恒牙根尖1/3

正确答案：A。成熟恒牙根尖1/3

解析：本题考查根折。年轻恒牙的牙槽骨较成熟恒牙的牙槽骨疏松，受到外伤时常发生错位。而成熟恒牙的牙槽骨致密，根尖1/3的牙根较细，抗折性差，因此根折常发生于成熟恒牙根尖1/3（A对）。年轻恒牙周围的牙槽骨尚有一定的可塑性，且牙根中1/3、年轻恒牙根尖1/3韧性高，外伤时不易折断（BE错）。成熟恒牙周围牙槽骨质地坚硬，牙根中1/3受力小不易折断（C错）；根颈侧1/3是整个牙根最粗壮的部位，较根尖1/3不易折裂（D错）。